下列富含维生素D的食物是
A. 牛奶
B. 蛋黄
C. 米饭
D. 蔬菜
E. 水果

正确答案：B。蛋黄